支气管镜检查对下述疾病诊断意义不大的是
A. 支气管肺癌
B. 弥漫性肺泡出血
C. 结节病
D. 支气管扩张
E. 肺孢子菌肺炎

正确答案：B。弥漫性肺泡出血

解析：支气管镜检查对肺癌的诊断、确定病变范围、明确手术指征与方式有帮助（A错）（八版内科学P82）；弥漫性肺泡出血是一组包括咯血、贫血、弥漫性X线肺泡浸润和低氧性呼吸衰竭等的临床症候群，其肺泡损伤可源于肺部，亦可源于系统性疾病，经支气管镜活检常不够充分（B对）；结节病可以通过支气管黏膜活检、TBLB、经支气管淋巴结针吸和支气管内引导活检得到诊断，这些检查的诊断率较高，风险低，成为目前肺结节病的重要确诊手段（C错）（P95）；纤维支气管镜检查有助于支气管扩张的诊治，当支气管扩张呈灶性且位于段支气管以上时，可发现弹坑样改变（D错）（P39）；肺孢子菌肺炎，病原学检查可用痰或诱导痰标本，经支气管镜刷检、肺活检和肺泡灌洗等标本染色观察包囊壁、子孢子（E错）（P57）。